类风湿关节炎湿热痹阻证，治疗宜选
A. 丁氏清络饮
B. 桂枝芍药知母汤
C. 四妙丸
D. 身痛逐瘀汤
E. 独活寄生汤

正确答案：C。四妙丸

解析：类风湿关节炎湿热痹阻证的病机为湿热之邪壅于经络关节，气血壅滞不通，故治疗当清热、利湿、通络，宜选清热祛湿通络的四妙丸加减（C对）。丁氏清络饮（A错）可清络去暑，用于治疗暑热伤肺轻证。桂枝芍药知母汤（B错）可祛风散寒，清热化湿，用于治疗寒热错杂证。身痛逐瘀汤（D错）可活血化瘀，祛痰通络，用于治疗痰瘀互结证。独活寄生汤（E错）可益肝肾，补气血，祛风湿，通经络，用于治疗肝肾亏虚证证。